阿司匹林引起的皮疹和神经血管性水肿
A. 变态反应
B. 后遗效应
C. 毒性反应
D. 特异质反应
E. 副作用

正确答案：A。变态反应